上87│78及上6│6远中颊根、牙周膜、牙槽骨、颊侧牙龈受哪一神经支配
A. 下牙槽神经
B. 上牙槽中神经
C. 上牙槽后神经
D. 鼻腭神经
E. 腭前神经

正确答案：C。上牙槽后神经

解析：上牙槽后神经麻醉区域及效果：除第一磨牙颊侧近中根外的同侧磨牙的牙髓、牙周膜、牙槽突及其颊侧的骨膜、牙龈黏膜。注意第一磨牙的颊侧近中根为上牙槽中神经支配，因此在拔除上颌第一磨牙时，尚需在第一磨牙近中根颊侧相应部位的移行沟黏膜转折处补行浸润麻醉。掌握“颌面部常用局麻法及牙拔除的麻醉选择”知识点。